五行中木“所不胜”的是
A. 水
B. 木
C. 土
D. 金
E. 火

正确答案：D。金

解析：在相克关系中，任何一行都具有“克我”和“我克”两方面关系，克我者为我“所不胜”，我克者为我“所胜”。金克木，金为木“所不胜”（D对）。水克火，水为火“所不胜”（A错）。金克木，木为金“所胜”（B错）。木克土，土为木“所胜”（C错）。水克火，火为水“所胜”（E错）。